属于三苯乙烯衍生物，可用于治疗雌激素依赖型乳腺癌的药物是
A. 氯米芬
B. 萘替芬
C. 雷洛昔芬
D. 他莫昔芬
E. 特比萘芬

正确答案：D。他莫昔芬

解析：本题考查选择性雌激素受体调节药的性质和代谢。他莫昔芬（D对）为三苯乙烯衍生物，用于治疗雌激素依赖型的乳腺癌。